女，31岁，已婚。停经58天，阴道少量流血、下腹隐痛4天。妇科检查：宫口闭，子宫如孕50天大，质软，双侧附件区未触及异常。B超显示有心管搏动。应首选的处理措施是
A. 肌肉注射缩宫素治疗
B. 肌肉注射苯巴比妥
C. 保胎治疗
D. 立即行清宫术
E. 肌肉注射麦角新碱

正确答案：C。保胎治疗

解析：中年女性患者，已婚。停经58天，阴道少量流血、下腹隐痛4天。妇科检查：宫口闭，子宫如孕50天大，质软，双侧附件区未触及异常。B超显示有血管搏动。综合患者的症状、体征和辅助检查，初步诊断为先兆流产，应首选的处理措施是保胎治疗（C对）。肌肉注射缩宫素治疗（A错）适用于引产催产、预防及治疗产后出血。肌肉注射苯巴比妥（B错）不适用于孕妇。立即行清宫术（D错）适用于难免流产。肌肉注射麦角新碱（E错）适用于产后出血、子宫复旧不良、月经过多等。